衣原体与病毒的不同点是
A. 可用鸡胚接种进行培养
B. 可通过细菌滤器
C. 专性细胞内寄生
D. 可在感染细胞中形成包涵体
E. 对抗生素敏感

正确答案：E。对抗生素敏感

解析：衣原体与病毒的主要区别在于其具有DNA、RNA两种核酸、核糖体和一个近似细胞壁的膜，并以二分裂方式进行增殖，能被抗生素抑制，衣原体属于原核类生物。掌握“衣原体”知识点。